在某地区进行男性吸烟与膀胱癌关系的研究，得到如下资料：吸烟组膀胱癌发病率为50/10万，不吸烟组膀胱癌发病率为25/10万。根据以上资料，计算该地区男性吸烟与膀胱癌关系的相对危险度为
A. 50/10万
B. 25/10万
C. 2
D. 0.5
E. 本资料不能计算

正确答案：C。2